牙周组织的常规检查器械不包括
A. 口镜
B. 口腔科镊子
C. 银汞充填器
D. 尖探针
E. 牙周探针

正确答案：C。银汞充填器

解析：牙周组织的检查器械常规用口镜、口腔科镊子、尖探针和牙周探针。掌握“牙周疾病检查”知识点。